育龄妇女在妊娠前接受口腔健康检查的目的不是
A. 及时处理口腔疾病
B. 及时发现口腔隐患
C. 保证口腔处于健康状态
D. 避免在怀孕期间发生口腔急症
E. 避免引起流产

正确答案：E。避免引起流产

解析：育龄妇女在计划怀孕前应主动接受口腔健康检查。检查的目的是及时发现并处理口腔疾病或隐患，确保口腔处于健康状态，避免在怀孕期间发生口腔急症，不便进行口腔治疗。掌握“妊娠期妇女口腔保健”知识点。